有关肝细胞性黄疸患者血尿中胆红素变化的描述，错误的是
A. 血清间接胆红素含量升高
B. 血清总胆红素含量升高
C. 血清直接胆红素含量升高
D. 直接胆红素含量低于间接胆红素
E. 尿胆红素阴性

正确答案：E。尿胆红素阴性

解析：肝细胞性黄疸时，肝细胞性受损伤，肝细胞摄取间接胆红素能力下降，血清间接胆红素升高（A对）；肝细胞膜破裂，直接胆红素释放过多，血清直接胆红素升高（C对），因此血清总胆红素升高（B对）。间接胆红素升高高于直接胆红素，且直接胆红素是水溶性的，易经肾脏排出，间接胆红素不溶于水，不能够经肾脏排出，故直接胆红素含量低于间接胆红素（D对）。尿胆红素由血液中升高的结合胆红素被肾小球滤过膜滤过而产生。肝细胞性黄疸时，肿胀的肝细胞及炎性细胞浸润压迫毛细胆管和胆小管，使胆汁排泄受阻反流入血液循环中，血液中直接胆红素增加，尿胆红素阳性（E错，为本题正确答案）。